药物的代谢反应主要发生在两个苯环上，代谢产物活性降低的药物是
A. 贝诺酯
B. 对乙酰氨基酚
C. 安乃近
D. 双氯芬酸钠
E. 布洛芬

正确答案：D。双氯芬酸钠

解析：本题考查解热、镇痛、抗炎药的体内代谢。双氯芬酸钠（D对）在体内的代谢主要以两个苯环的氧化为主，代谢产物活性降低或消失；贝诺酯（A错）是代谢产物对乙酰氨基酚发挥解热镇痛药效；对乙酰氨基酚（B错）、安乃近（C错）均在肝脏代谢，并非双苯环代谢；布洛芬（E错）等芳基丙酸类抗炎药（R）-对映体在体内可转化为高活性（S）-对映体。